急性坏死性溃疡性龈炎的发病特点不包括
A. 常发生于青壮年
B. 发病急，经常与精神紧张有关
C. 初起时龈乳头充血水肿，个别出现溃疡
D. 进展快，牙间乳头和边缘龈坏死
E. 病程长，牙龈出血，牙齿松动

正确答案：E。病程长，牙龈出血，牙齿松动

解析：本题考查急性坏死性溃疡性龈炎。急性坏死性溃疡性龈炎的发病特点不包括病程长，牙龈出血，牙齿松动（E错，为本题的正确答案）。急性坏死性溃疡性龈炎（ANUG）是指发生于龈缘和龈乳头的急性炎症和坏死。1.好发人群：NUG常发生于青壮年（A对），以男性吸烟者多见。在不发达国家或贫困地区亦可发生于极度营养不良或患麻疹、黑热病等急性传染病的儿童。2.病程：本病起病急（B对），病程较短，常为数天至1～2周。3.以龈乳头和龈缘的坏死为其特征性损害，尤以下颌前牙多见。初起时龈乳头充血水肿，在个别龈乳头的顶端发生坏死性溃疡（C对），上覆有灰白色污秽的坏死物，去除坏死物后可见龈乳头的颊、舌侧尚存，而中央凹下如火山口状。早期轻型患者应仔细检查龈乳头的中央，以免漏诊。病变迅速沿牙龈边缘向邻牙扩展（D对），使龈缘如虫蚀状，坏死区出现灰褐色假膜，易于擦去，去除坏死组织后，其下为出血创面。龈乳头被破坏后与龈缘成一直线，如刀切状。病损一般不波及附着龈。4.患处牙龈极易出血：患者常诉晨起时枕头上有血迹，口中有血腥味，甚至有自发性出血。5.疼痛明显：患者常诉有明显疼痛感，或有牙齿撑开感或胀痛感。6.有典型的腐败性口臭：由于组织的坏死，患者常有特殊的腐败性恶臭。7.全身症状：轻症NUG患者一般无明显的全身症状，重症患者可有低热、疲乏等全身症状，部分患者下颌下淋巴结可肿大，有压痛。